吸收的锰主要经
A. 肠道排出
B. 肾脏排出
C. 呼吸道排出
D. 唾液腺排出
E. 随汗液蒸发

正确答案：A。肠道排出

解析：本题考查锰的代谢。锰主要通过呼吸道吸收，消化道吸收较少。锰烟或锰尘经呼吸道吸收入血后，与血浆中的β₁-球蛋白结合为转锰素分布于全身，并迅速从血液中转移到在富有线粒体的肝、肾、胰、心、肺、脑的细胞中，少部分经胃肠道吸收的锰入肝。锰大多经胆囊分泌，随粪便（A对BCDE错）缓慢排出。